柴胡皂苷g是
A. Ⅰ型柴胡皂苷
B. Ⅲ型柴胡皂苷
C. Ⅲ型柴胡皂苷
D. Ⅳ型柴胡皂苷
E. V型柴胡皂苷

正确答案：D。Ⅳ型柴胡皂苷